乳房的说法，错误的是
A. 成年未产妇的乳房呈半球形
B. 乳头平第4肋间或第5肋与锁骨中线交叉处
C. 一侧乳房有15-20个乳腺小叶
D. 乳房脓肿切开引流时宜作弧形切口
E. 乳晕表面的隆起称乳晕腺

正确答案：D。乳房脓肿切开引流时宜作弧形切口

解析：成年未产妇的乳房呈半球形（A对），乳头平第4肋间或第5肋与锁骨中线交叉处（B对），一侧乳房有15-20个乳腺小叶（C对），乳腺叶和输乳管均以乳头为中心呈放射状排列，故乳房脓肿切开引流时宜作放射状切口，乳房后间隙脓肿（D错为本题正确答案）宜作弧形切口，乳晕表面的隆起称乳晕腺（E对）。